能使凝血因子Ⅰ降解为纤维蛋白单体的药物是
A. 蛇毒血凝酶
B. 甲萘氢醌
C. 鱼精蛋白
D. 卡巴克络
E. 氨基己酸

正确答案：A。蛇毒血凝酶

解析：本题考查药物的作用特点。蛇毒血凝酶（A对）具有类凝血酶样作用，能促进血管破损部位的血小板聚集，促使出血部位的血栓形成和止血。甲萘氢醌（B错）属于促凝血因子合成药。鱼精蛋白（C错）可特异性拮抗肝素的抗凝作用，有效地对抗肝素、低分子肝素过量引起的出血。卡巴克络（D错）可增强毛细血管对损伤的抵抗力，降低毛细血管的通透性，促进受损的毛细血管端回缩而促进凝血。氨甲环酸、氨基己酸（E错）为氨基酸类抗纤溶酶药。